女，60岁，右髋部疼痛20余年，近2年加重。步行200米即出现明显髋痛，不能盘腿，髋关节内外旋均受限。X线检查示右髋骨关节间隙消失，关节边缘骨质增生，股骨头变扁，头臼失去正常对合关系。首先的治疗方法是
A. 关节镜清理术
B. 人工全髋关节置换术
C. 股骨近端截骨术
D. 口服非甾体抗炎药
E. 人工股骨头置换术

正确答案：B。人工全髋关节置换术

解析：中老年女性患者，右髋部疼痛20余年，髋关节内外旋均受限（股骨头坏死典型表现），X线检查示右髋骨关节间隙消失、关节边缘骨质增生、股骨头变扁（股骨头坏死典型影像学表现），结合患者病史、体查及影像学表现，该患者最可能的诊断为股骨头坏死Ⅳ期。患者年龄较大，髋臼、股骨头均受累、生活质量已明显受到影响，所以该患者的首选治疗方法应为人工全髋关节置换术（B对）。关节镜清理术（A错）主要用于骨关节炎的治疗。股骨近端截骨术（C错）主要适用于Ⅱ期患者。口服非甾体抗炎药（D错）为保守治疗方法，适用于病变较轻的Ⅰ期患者。人工股骨头置换术（E错）常用于股骨颈骨折的治疗。